种植覆盖全口义齿上颌简单的覆盖义齿可以需要由至少种植体
A. 一个
B. 两个
C. 三个
D. 四个
E. 五个

正确答案：D。四个

解析：本题考查种植覆盖全口义齿。种植覆盖全口义齿的特点：通过无牙颌患者牙槽嵴内植入种植体，种植体上部放置切削杆、套筒冠、杆卡结构或独立的球帽式固位装置等为修复体提供固位、稳定和支持。在下颌，简单的覆盖义齿可以由少至两个的种植体支持，在上颌则需要至少四个（D对）种植体。